一个昏迷病人被送到医院，医生对他进行处理，这种医患关系属于
A. 主动-被动型
B. 指导-合作型
C. 共同参与型
D. 强制-被动型
E. 指导-参与型

正确答案：A。主动-被动型

解析：主动-被动型：这是一种最常见的单向性的，以生物医学模式为指导思想的医患关系，在现代医学实践中仍普遍存在，其特征为“医生为病人做什么”。这种模式主要适用于昏迷、休克、全麻、有严重创伤及精神病人的医疗过程，这种病人或失去意识或不能表达自己的要求，只能听命于医生的安排。掌握“医患沟通的理论、技术与其应用以及医患关系模式”知识点。